不属于医学心理学基本观点的是
A. 心身统一
B. 被动调节
C. 情绪作用
D. 个性特征
E. 认知评价

正确答案：B。被动调节